患者，女，56岁。咳喘10年，伴见胸闷心悸，咯痰清稀，声低乏力，面白神疲，舌质淡白，脉弱。其证候是
A. 心肺气虚
B. 肺气虚
C. 寒邪客肺
D. 脾肺气虚
E. 肾不纳气

正确答案：A。心肺气虚

解析：本证多因久病咳喘，耗伤肺气，累及于心使心肺之气虚损所致。患者胸闷心悸是由于宗气亏虚，气滞心胸及心气虚弱，鼓动无力所致，属心气虚；患者咳痰清稀并有咳喘是由于肺气虚弱，呼吸功能减退，失于宣降及肺气虚，不能输布津液所致，属肺气虚；患者声低乏力，面白神疲，舌质淡白，脉弱是气虚之征，故患者辨证为心肺气虚证（A对）。因患者见有胸闷心悸等心气虚证，故选项B、C中没有体现此症状（BC错）。脾肺气虚证指脾肺两脏气虚，以咳嗽、气喘、咳痰、食少、腹胀、便溏与气虚症状为主要表现的证候，而该患者并没有出现脾气虚的症状（D错）。肾不纳气证指肺肾气虚，摄纳无权，以久病咳喘、呼多吸少、动则尤甚与气虚症状为主要表现的证候（E错）。